职业性致癌物包括
A. 确认致癌物
B. 可疑致癌物
C. 潜在致癌物
D. 动物致癌物
E. A、B、C三项

正确答案：E。A、B、C三项

解析：本题考查职业性致癌物的种类。职业性致癌物包括确认致癌物、可疑致癌物和潜在致癌物（E对ABCD错）。目前，经IARC综合评估后定性为1类，即确定对人类有致癌性的单一因素、混合物或暴露环境共118种；2A类（很可能对人类有致癌性）80种，2B类（可能对人类有致癌性）289种；3类（对人类致癌性不能分类）502种；4类（可能对人类没有致癌性）1种。